血友病患者可能出现的凝血因子异常是
A. 缺少凝血因子Ⅲ和Ⅹ
B. 缺少凝血因子Ⅲ和Ⅴ
C. 缺少凝血因子Ⅱ和Ⅹ
D. 缺少凝血因子Ⅷ和Ⅸ
E. 缺少凝血因子Ⅳ和Ⅶ

正确答案：D。缺少凝血因子Ⅷ和Ⅸ

解析：血友病是一组遗传性凝血因子生成障碍引起的出血性疾病，该病的发生是缺少凝血因子Ⅷ和Ⅸ（D对），其包括了血友病A和血友病B，血友病A又称FⅧ缺乏症…血友病B又称遗传性FⅨ缺乏症，以血友病A为常见。血管性血友病为血浆vWF的异常，应注意区分。缺少凝血因子Ⅱ和Ⅹ（C错）为维生素K缺乏可出现的凝血因子异常。